患者，男，56岁，胸部刺痛，固定不移，晚上疼痛加重，时或心悸不宁，舌质紫暗，脉象沉涩，选方
A. 瓜蒌薤白白酒汤
B. 瓜蒌薤白半夏汤
C. 血府逐瘀汤
D. 参附汤
E. 生脉散

正确答案：C。血府逐瘀汤

解析：题中患者以胸部刺痛，固定不移为主，诊断为胸痹。时或心悸不宁，舌质紫暗，脉沉涩为血行瘀滞，心脉不畅所致，是心血瘀阻证的表现，治宜活血化瘀，通脉止痛，代表方为血府逐瘀汤（C对）。瓜蒌薤白白酒汤治疗胸阳不振，痰阻气滞所致的胸痹（A错）。瓜蒌薤白半夏汤治疗痰浊闭阻证之胸痹（B错）。参附汤治疗阳气暴脱证（D错）。生脉散治疗气阴两伤证（E错）。